一氧化碳中毒的主要毒作用机理是
A. 抑制血红蛋白合成
B. 抑制中枢神经系统功能
C. 抑制血红蛋白对氧的运输
D. 抑制细胞对氧的利用
E. 抑制呼吸系统功能

正确答案：C。抑制血红蛋白对氧的运输

解析：本题考查一氧化碳中毒的毒作用机制。急性CO中毒引起机体缺氧窒息最主要的机制是CO与Hb结合形成HbCO，经呼吸道吸入的CO绝大部分与Hb分子中原卟啉Ⅸ的亚铁复合物发生紧密而可逆性结合，形成HbCO使Hb失去携氧能力，导致组织缺氧（C对ABDE错）。其次，CO与肌红蛋白结合形成碳氧肌红蛋白，影响氧从毛细血管向细胞线粒体弥散，损害线粒体功能。